医疗保险的特点是
A. 保障对象的广泛性
B. 补偿形式的特殊性
C. 保险风险的难控制性
D. 运行机制的复杂性
E. 以上都是医疗保险的特点

正确答案：E。以上都是医疗保险的特点

解析：本题考查医疗保障。医疗保险的特点：①保障对象的广泛性（A对）；②补偿形式的特殊性（B对）；③运行机制的复杂性（D对）；④保险风险的难控制性（C对）。因此选E。